患儿，女，8岁，右上颌中切牙外伤冠折，切角缺损，即刻来院就诊。口腔检查发现：穿髓孔大，探痛明显，可疑叩痛。治疗首选
A. 直接盖髓术
B. 活髓切断术
C. 拔髓术
D. 根管治疗术
E. 塑化疗法

正确答案：B。活髓切断术

解析：本题考查年轻恒牙冠折的治疗。患儿，女，8岁，右上颌中切牙外伤冠折（年轻恒牙冠折），切角缺损，即刻来院就诊。口腔检查发现：穿髓孔大，探痛明显，可疑叩痛（牙髓炎）。治疗首选活髓切断术（B对）。生活的牙髓是年轻恒牙继续发育的保障，年轻恒牙冠折露髓后应尽可能保存活髓（CD错）。年轻恒牙的牙髓组织抵抗力较强，若露髓孔不大（1mm以内）且外伤时间短（1～2小时内），可行直接盖髓治疗（A错）。但临床经验表明，直接盖髓成功率较低。牙髓切断术或部分牙髓切断术是治疗年轻恒牙外伤露髓的首选方法。研究表明外伤造成的牙髓外露，牙髓感染的范围很局限，一般在露髓孔周围2mm以内，所以，外伤露髓后相当长的时间内（数）都可以尝试使用牙髓切断术。塑化疗法（E错）指将根管内部分牙髓抽出，不必进行扩大根管等复杂的操作步骤，而将配好的塑化液注入根管，与牙髓组织聚合在一起，达到消除病原刺激物的作用。